下述哪项因素与疠气流行较不密切
A. 精神因素
B. 气候反常
C. 社会因素
D. 环境因素
E. 预防措施不当

正确答案：A。精神因素

解析：影响疠气产生的因素有多种，主要有气候因素（B对）、环境因素（D对）、预防措施（E对）和社会因素（C对）等，与精神因素关系不密切（A错，为本题正确答案）。